中医学认为引起高血压病的病机关键是
A. 肝肾阴阳失调
B. 肝脾疏泄失调
C. 肺肾吐纳失调
D. 心肾交济失调
E. 心肺相辅失调

正确答案：A。肝肾阴阳失调

解析：高血压一病主要病因为情志失调、饮食不节、久病劳伤、先天禀赋不足等。中医对主要病理环节的认识不外乎风、火、痰、瘀、虚，与肝、脾、肾的关系密切。病机性质为本虚标实，肝肾阴虚为本，肝阳上亢、痰瘀内蕴为标，气血阴阳失调，脉络失养，或清阳不升，或痰火扰动清窍而发病，肝肾阴阳失调（A对）为总病机（BCDE错）。